大建中汤的功用是
A. 温中补虚，理气健脾
B. 温中补虚，和里缓急
C. 温中补虚，降逆止痛
D. 温中补虚，降逆止呕
E. 温中补虚，散寒止痛

正确答案：C。温中补虚，降逆止痛

解析：该题考查大建中汤的功用。大建中汤功能温中补虚，降逆止痛，主治，中阳衰弱，阴寒内盛之脘腹剧痛证.大建中汤中的蜀椒，干姜为辛甘之品温建中阳，人参用来补虚，此方有降逆止呕的作用。（C对）。